与茶碱合用会造成茶碱血药浓度升高的是
A. 甘草
B. 银杏
C. 烟草
D. 人参
E. 苦瓜

正确答案：C。烟草